六个月以内婴幼儿、肾衰者禁用
A. 马来酸氯苯那敏
B. 赖氨酸阿司匹林
C. 碱式硝酸铋复方制剂
D. 盐酸地芬尼多
E. 硫酸沙丁胺醇

正确答案：D。盐酸地芬尼多